自肺开始叩诊肝脏相对浊音界时其叩诊音应是
A. 由清音转为实音
B. 由浊音变为实音
C. 由清音转为鼓音
D. 由过清音转为实音
E. 由清音转为浊音

正确答案：E。由清音转为浊音

解析：正常胸部叩诊为清音，当向下叩诊，清音转为浊音（E对）时，此时叩诊到肝上界，由于此处的肝脏被肺下叶遮盖，此处又称肝相对浊音界，再往下叩诊1-2个肋间，则浊音变为实音，由于此处的肝脏不在被肺叶掩盖而贴近胸壁，此处又称肝绝对浊音界，此处即为肝下界。